下列有关外耳道的描述何者错误
A. 外1／3为软骨部
B. 内2／3为骨部
C. 在成人，检查鼓膜时应将耳郭拉向后上方
D. 因婴儿的外耳道宽阔，鼓膜近水平位，故检查时应将耳郭拉向后下方
E. 除平衡鼓膜内外大气压外，无其他重要功能

正确答案：D。因婴儿的外耳道宽阔，鼓膜近水平位，故检查时应将耳郭拉向后下方

解析：外耳道外 1/3 为软骨部（A对）。内2/3 为骨性部（B对）。检查鼓膜时，成人需将耳郭向后上方（C对）牵拉，使外耳道变直，方可窥见。婴儿外耳道短而直，鼓膜近于水平位，检查时须将耳郭拉向后下方（D对）。